妊娠期妇女，对选择性手术较为安全的手术时间是
A. 怀孕的第1个月
B. 怀孕的第3个月
C. 怀孕的第5个月
D. 怀孕的第7个月
E. 怀孕的第9个月

正确答案：C。怀孕的第5个月

解析：本题考查牙拔除的适应证与禁忌证。对于引起极大痛苦、必须拔除的牙，在妊娠期间皆可进行，但对选择性手术，则应在怀孕的第4～6月（C对）期间进行较为安全。